临产后第一产程活跃期的最大加速期是指
A. 宫口扩张2～7cm
B. 宫口扩张1～6cm
C. 宫口扩张4～9cm
D. 宫口扩张3～8cm
E. 宫口扩张5～10cm

正确答案：C。宫口扩张4～9cm

解析：临产后第一产程活跃期的最大加速期是指宫口扩张4～9cm（C对），约需2小时。